血热是指
A. 气血失和，不荣经脉
B. 血随气逆，咯血或呕血
C. 血液不足，濡养功能减弱
D. 血液循行迟缓或不畅或停滞
E. 血分有热，血行加速或迫血妄行

正确答案：E。血分有热，血行加速或迫血妄行

解析：血热指热入血脉，使血行加速，脉络扩张，或灼伤血脉，迫血妄行的病机变化（E对）。气和血之间具有相互资生、相互依存和相互为用的关系，气血两虚，则脏腑经络、形体官窍失之濡养，各种生理功能失常，可出现不荣或不用的病证（A错）。气能行血，若气机逆乱，升降出入失常，也会影响血液正常运行，导致血液妄行，出现血随气逆的咳血、吐血或呕血症状（B错）。血虚是指血液不足，血的濡养功能减退的病机变化（C错）。血瘀是指血液循行迟缓，流行不畅，甚则血液停滞的病机变化（D错）。